呼吸衰竭易并发功能性肾衰这是由于
A. 产生广泛性肾小球器质性损伤
B. 酸中毒导致血清K⁺浓度增高
C. 肺过度通气，血氧升高
D. 肾血流量严重减少
E. 易产生急性肾小管坏死

正确答案：D。肾血流量严重减少

解析：肾衰竭的发生是由于缺氧与高碳酸血症反射性地通过交感神经使肾血管收缩，肾血流量严重减少（D对）所致。